安乐死的定义
A. 自然死亡
B. 他人干预死亡
C. 无痛苦死亡
D. 脑死亡
E. 自己结束生命

正确答案：C。无痛苦死亡

解析：安乐死是指病人患有无法治愈的疾病、已经处于不可逆转的濒临死亡且承受剧烈病痛折磨的状态之中，为消除其肉体和精神痛苦，应其要求，应用医学手段使其无痛苦地结束生命的死亡方式（C对）。